帕金森病诊断不包括哪个选项
A. 偏侧肢体起病
B. 动作缓慢
C. 肌肉僵直
D. 静止性震颤
E. 感觉异常

正确答案：E。感觉异常

解析：帕金森病，又名震颤麻痹，是一种常见于中老年的神经系统变性疾病，临床上以静止性震颤、运动迟缓、肌强直和姿势平衡障碍为主要特征。我国帕金森病诊断标准主要是依据中老年发病，缓慢进展性病程，必备运动缓慢（B对），至少具备静止性震颤（D对）、肌强直（C对）或姿势平衡障碍中的一项，偏侧肢体起病（A对），对左旋多巴治疗敏感即可作出临床诊断，其中并未提到感觉异常（E错，为本题正确答案）作为诊断依据。